研究医师的医疗行为宜采用的方法是
A. 文献法
B. 观察法
C. 小组访谈法
D. 问卷法
E. 信访法

正确答案：B。观察法